全冠试戴时，冠修复体就位不能检查到的表现为
A. 龈边缘达到位置
B. 稳定性好
C. 咬合基本合适
D. 冠很容易取下
E. 无翘动

正确答案：D。冠很容易取下

解析：冠就位的标志①冠的龈边缘到达设计的位置，有肩台预备的颈缘应与冠边缘密合无明显缝隙。②制备良好的人造冠就位后，咬合应基本合适，或稍加修整即合适。③人造冠在患牙上就位后不出现翘动现象。掌握“修复体试戴、磨光与粘固”知识点。